表面白色、灰白色或淡黄色，有的半透明。纵断面具绢丝样光泽的矿物药是
A. 硫黄
B. 石膏
C. 炉甘石
D. 芒硝
E. 滑石

正确答案：B。石膏

解析：本题考查的是石膏药材的性状鉴别。表面白色、灰白色或淡黄色，有的半透明。纵断面具绢丝样光泽的矿物药是石膏（B对）。石膏：【性状鉴别】药材为纤维状的集合体。呈长块状、板块状或不规则块状。白色、灰白色或淡黄色，有的半透明。体重，质软，纵断面具绢丝样光泽。气微，味淡。硫黄（A错）：【性状鉴别】药材呈不规则块状。黄色或略呈绿黄色。表面不平坦，呈脂肪光泽，常有多数小孔。用手握紧置于耳旁，可闻轻微的爆裂声。体轻，质松，易碎，断面常呈针状结晶形。有特异的臭气，味淡。炉甘石（C错）：【性状鉴别】药材为块状集合体，呈不规则块状。灰白色或淡红色，表面粉性，无光泽，凹凸不平，多孔，似蜂窝状。体轻，易碎。气微，味微涩。芒硝（D错）：【性状鉴别】药材为棱柱状、长方形或不规则块状及粒状。无色透明或类白色半透明。质脆，易碎，断面呈玻璃样光泽。气微，味咸。滑石（E错）：【性状鉴别】药材多为块状集合体。呈不规则块状。白色、黄白色或淡蓝灰色，有蜡样光泽。质软，细腻，手摸有滑润感，无吸湿性，置水中不崩散。气微，味淡。